根据《最高人民法院、最高人民检察院关于办理生产、销售假药、劣药刑事案具体应用法律若干问题的解释》，生产、销售的劣药被使用后造成中度残疾的，应认定为
A. 足以严重危害人体健康
B. 对人体健康造成严重危害
C. 对人体健康造成特别严重危害
D. 后果特别严重
E. 对人体健康造成特别重大损害

正确答案：B。对人体健康造成严重危害

解析：本题考查生产、销售、使用劣药的刑事责任。根据《最高人民法院、最高人民检察院关于办理生产、销售假药、劣药刑事案具体应用法律若干问题的解释》，生产、销售的劣药被使用后造成中度残疾的，应认定为（B对）。根据《最高人民法院、最高人民检察院关于办理危害药品安全刑事案件适用法律若干问题的解释》第五条第二款规定，生产、销售、提供劣药，具有下列情形之一的，应当认定为刑法第一百四十二条规定的“对人体健康造成严重危害”：①造成轻伤或者重伤的；②造成轻度残疾或者中度残疾的；③造成器官组织损伤导致一般功能障碍或者严重功能障碍的；④其他对人体健康造成严重危害的情形。生产、销售劣药，致人死亡，或者具有下列情形之一的，应当认定为“后果特别严重”（D错）：①致人重度残疾的；②造成三人以上重伤、中度残疾或者器官组织损伤导致严重功能障碍的；③造成五人以上轻度残疾或者器官组织损伤导致一般功能障碍的；④造成十人以上轻伤的；⑤造成重大、特别重大突发公共卫生事件的。